患者，女，52岁，二度房室传导阻滞病史多年，近期发现血压升高，非同日3次测量诊室血压均高于160/90mmHg，不宜选用的抗高血压药物是
A. 氢氯噻唪
B. 氨氯地平
C. 美托洛尔
D. 依那普利
E. 厄贝沙坦

正确答案：C。美托洛尔

解析：本题考查美托洛尔。该患者Ⅱ度房室传导阻滞多年，不宜选用的抗高血压药物是美托洛尔（C错，为本题正确答案）。美托洛尔为β₁受体阻断剂，可通过阻断β肾上腺素受体，降低交感神经活性，减轻由β受体介导的心律失常；对β₂受体影响相对较小。主要用于高血压、心绞痛、心肌梗死、慢性心力衰竭、预防和治疗急性心肌梗死患者的心肌缺血、快速型心律失常和胸痛。美托洛尔的不良反应主要是可引起支气管痉挛、心功能抑制、疲乏、肢体冷感、激动不安等。二至三度房室传导阻滞、严重支气管哮喘患者禁用。慢性阻塞性肺疾病、运动员、周围血管疾病或糖耐量异常者慎用。该患者可选用氢氯噻嗪（A对）、氨氯地平（B对）、依那普利（D对）、厄贝沙坦（E对）。氢氯噻嗪的不良反应主要是低血钾、低血钠、血尿酸升高等。氨氯地平的不良反应主要是引起心跳加快、踝部水肿，头痛，面部潮红，牙龈增生。依那普利的主要不良反应为干咳、低血压、皮疹、血管神经性水肿、味觉障碍、血钾升高等。厄贝沙坦属于血管紧张素II受体阻断剂，适用于治疗原发性高血压，但在妊娠初始3个月内不宜使用本品。